关于栓剂中药物吸收的叙述，错误的是
A. 药物从直肠吸收的机制主要是被动扩散
B. 栓剂塞入直肠的深度不同，其吸收也不同
C. 直肠液的pH为7.4，具有较强的缓冲能力
D. 栓剂在直肠保留时间越长，吸收越完全
E. 直肠内无粪便存在，有利于吸收

正确答案：C。直肠液的pH为7.4，具有较强的缓冲能力

解析：本题考查栓剂中药物的吸收。一般直肠液的pH为7.4左右，并且不具有缓冲能力（C错，为本题正确答案）。药物从直肠吸收依靠浓度差进入血液，为被动扩散（A对），因此在直肠保留时间越长，吸收越完全（D对），并且无粪便时，吸收更好（E对）；栓剂塞入直肠的深度不同，吸收途径不同（B对）。